患者，男，65岁。突感上腹部剧烈疼痛。取硝酸甘油片含服，未能缓解。查体：脸色青白，血压80/60mmHg（10.67/7.98kPa），除心率140次/分外，心肺听诊无异常，腹平软，无压痛、反跳痛，鸣音存在，应首先考虑的是
A. 胃痉挛
B. 胃穿孔
C. 急性胰腺炎
D. 心绞痛
E. 心肌梗死

正确答案：E。心肌梗死

解析：心肌梗死大多是在冠脉病变的基础上，发生冠脉血供急剧减少或中断，使相应的心肌严重而持久地急性缺血所致。本例患者为老年男性，有突发上腹部疼痛病史，且含服硝酸甘油症状未能缓解，同时伴有面色苍白、低血压、心动过速等休克表现，胸部、腹部查体无异常体征，故诊断首先考虑的是心肌梗死（E对）。胃痉挛（A错）主要表现为上腹痛、呕吐等，症状相对较轻，通常不会出现休克。胃穿孔（B错）好发于胃溃疡病人，主要表现为突发剧烈腹痛，腹部查体时可见腹肌紧张、有压痛、反跳痛等腹膜刺激征表现。急性胰腺炎（C错）的主要表现为中左上腹持续性腹痛，疼痛可向背部放射，部分患者腹部查体可见肠鸣音减少。心绞痛（D错）的主要表现为胸骨后紧缩性痛，发作常由体力劳动或情绪激动所诱发，舌下含服硝酸甘油后症状缓解。